男，68岁。反复咳嗽、咳痰20年，气短10年喘息加重2天。吸烟30年，每日约1包。查体：神志清楚，呼吸急促，端坐位，口唇发绀，桶状胸，左下肺呼吸音明显减弱，右肺可闻及哮鸣音和湿啰音。WBC6.3×10⁹/L，N0.85。为进一步诊治，首选的检查是
A. 肺功能
B. 血气分析
C. 痰培养
D. 心电图
E. 胸部X线片

正确答案：E。胸部X线片

解析：患者为老年男性，吸烟30年，每日约1包（为慢阻肺最重要的环境发病因素），反复咳嗽、咳痰20年，气短10年，口唇发绀，桶状胸，考虑诊断为慢性阻塞性肺疾病（COPD）。COPD的患者喘息加重2天，呼吸急促，端坐位，左下肺呼吸音明显减弱，考虑为COPD并发自发性气胸（为COPD最常见的并发症），首选确诊方法为胸部X线片（E对）。肺功能（A错）用于鉴别呼吸困难的原因，对诊断病变部位、评估肺功能对手术的耐受力或劳动强度耐受力及对危重病人的监护等方面有重要的指导意义。痰培养（C错）多用于肺炎病原体的诊断。心电图（D错）主要是了解各种心律失常、心肌缺血/梗死、房室肥大或电解质紊乱等。血气分析（B错）用于判断机体是否存在酸碱平衡失调以及缺氧和缺氧程度等。